新生儿居室湿度宜保持在
A. 30%～40%
B. 40%～50%
C. 50%～60%
D. 60%～70%
E. 70%以上

正确答案：C。50%～60%

解析：本题考查新生儿的保健要点。新生儿居室的温度与湿度应随气候温度变化调节，有条件的家庭在冬季应使室内温度保持在20～22℃，湿度以55%（C对ABDE错）为宜，夏季应避免室内温度过高。